阿米卡星结构中α-羟基酰胺侧链构型与活性关系正确的是
A. L-（-）-型活性最低
B. L-（-）-型活性最高
C. D-（+）-型活性最低
D. D-（+）-型活性最高
E. DL-（±）-型活性最低

正确答案：B、C。L-（-）-型活性最高；D-（+）-型活性最低

解析：本题考查阿米卡星。阿米卡星为卡那霉素的半合成衍生物的硫酸盐，临床用于对庆大霉素、卡那霉素耐药菌引起的严重感染。结构中α-羟基酰胺侧链含有手型碳原子，其活性最大的构型为L-（-）-型（B对A错）；若为D-（+）-型，其抗菌活性大为降低（C对D错）；若为DL-（±）-型，则抗菌活性降低一半（E错）。